女，20岁。主诉自初中毕业后，越来越不能与陌生人接触，近1年来发展为见到熟人也害怕与之说话，且一说话就脸红，对于该患者心理治疗首选的方法为
A. 生物反馈
B. 系统脱敏
C. 自由联想
D. 催眠治疗
E. 人本主义

正确答案：B。系统脱敏